患者，女，75岁，戴用全口义齿一月，复查时自述戴牙后一直感觉咀嚼无力，口角下垂，检查发现（牙合）关系正常，息止间隙偏大。原因可能为
A. 年龄大不适应
B. 人工牙为塑料牙
C. 垂直距离过低
D. 关节功能紊乱
E. （牙合）关系有误

正确答案：C。垂直距离过低

解析：本题考查全口义齿颌位关系及上（牙合）架。垂直距离恢复得过小（C对）表现为面部下1/3的距离减小，唇红部显窄，口角下垂，鼻唇沟变深，颏部前突。全口义齿戴入口中，看上去患者像没戴义齿似的，息止间隙偏大，咀嚼时用力较大，而咀嚼效能较低。